关于循证医学的实质，以下说法最为恰当的是
A. 循证医学就是进行系统综述和临床试验
B. 循证医学就是临床流行病学
C. 循证医学就是基于证据进行实践
D. 循证医学就是检索研究证据
E. 循证医学就是评价出最好的研究证据

正确答案：C。循证医学就是基于证据进行实践

解析：本题考查循证医学的相关内容。证据是循证医学的基石，遵循证据进行实践（C对ABDE错）是循证医学的本质所在。